临床上最常见的根尖周病是
A. 急性根尖周炎浆液期
B. 急性根尖周炎化脓期
C. 慢性根尖周炎
D. 急性牙髓炎
E. 中央性颌骨骨髓炎

正确答案：C。慢性根尖周炎

解析：慢性根尖周炎是临床上最常见的根尖周疾病，很多急性根尖周炎均是慢性病变的急性发作。掌握“慢性根尖周炎”知识点。